下列除哪项外，均属病理性胎黄
A. 生后24小时内出现
B. 黄疸10〜14天消退
C. 黄疸退而复现
D. 黄疸持续加深
E. 黄疸3周后仍不消退

正确答案：B。黄疸10〜14天消退

解析：新生儿黄疸有生理性和病理性黄疸之分。病理性黄疸出现多早于生理性黄疸，在出生24小时内即可出现（A错），而消退较生理性黄疸迟，生理性黄疸多在10~14天消退（B对），病理性黄疸可在消退后复现（C错），并持续加深（D错）。病理性黄疸消退较迟，多在3周后仍不消退（E错）。